脾功能亢进时主要减少的细胞是
A. 中性粒细胞
B. 嗜酸性粒细胞
C. 嗜碱性粒细胞
D. 淋巴细胞
E. 单核细胞

正确答案：A。中性粒细胞

解析：中性粒细胞减少常见于①感染∶病毒感染最常见，如流行性感冒、麻疹、病毒性肝炎、水痘、风疹、巨细胞病毒感染等；某些革兰阴性杆菌感染如伤寒、副伤寒；某些原虫感染如恙虫病、疟疾等。②血液系统疾病：如再生障碍性贫血、白细胞不增多性白血病、骨髓纤维化、阵发性血红蛋白尿、恶性组织细胞病以及骨髓转移癌等。③药物及理化因素：如氯霉素、抗肿瘤药物（塞替派、白消安等）、抗结核药物（利福平、氨硫脲）、抗甲状腺药物（甲巯咪唑、卡比马唑）、解热镇痛药、抗糖尿病药、磺胺药；X线、放射性核素、苯、铅等。④自身免疫性疾病：如系统性红斑狼疮（SLE）等。⑤脾功能亢进：各种原因引起的脾脏肿大，如肝硬化、班替综合征等（A对）。嗜酸粒细胞减少；见于伤寒、副伤寒、应激状态（如严重烧伤、急性传染病的极期）、休克、库欣综合征等（B错）。嗜碱粒细胞增多见于变态反应性疾病、慢性粒细胞白血病、嗜碱粒细胞白血病、转移癌、骨髓纤维化、慢性溶血等。其减少一般无临床意义（C错）。淋巴细胞减少：主要见于使用肾上腺糖皮质激素、烷化剂，接触放射线免疫缺陷性疾病等（D错）。核细胞进入组织后转变为巨噬细胞，称单核-吞噬细胞系统。单核细胞增多见于：①生理性：<2周的新生儿可达0.15或更多，儿童平均为0.09。②病理性∶：某些感染，如亚急性感染性心内膜炎、活动性结核病、疟疾、急性感染的恢复期；某些血液病，如单核细胞白血病、粒细胞缺乏症恢复期、多发性骨髓瘤和淋巴瘤等（E错）。